慢性甲基汞中毒的靶器官是
A. 血管
B. 中枢神经系统
C. 肝
D. 肾
E. 心脏

正确答案：B。中枢神经系统

解析：本题考查慢性甲基汞中毒的靶器官。慢性甲基汞中毒的主要靶器官是中枢神经系统（B对ACDE错），最突出的症状是神经精神症状，早期表现为神经衰弱综合征。少数严重者，症状可持续发展加重，表现为精神障碍。严重者可出现神志障碍、谵妄、昏迷、锥体外系受损等。